牙石的致病作用主要包括
A. 表面常可形成未钙化的菌斑
B. 本身坚硬粗糙，对牙龈有机械刺激
C. 多孔结构容易吸附大量的细菌毒素
D. 妨碍日常口腔卫生措施的实施
E. 以上均是

正确答案：E。以上均是

解析：本题考查牙石的致病作用。牙石是沉积在牙面或修复体表面上已矿化或正在矿化的菌斑沉积物（AB对），牙石多孔的结构也容易吸收大量的细菌毒素（C对）由唾液与龈沟与牙周病关系密切，牙石形成后不能用刷牙的方法去除（D对），牙石量与牙周炎呈明显的正相关，牙石根据沉积的部位，以龈缘为界，分为龈上牙石和龈下牙石。综上，以上均是（E对，为本题正确答案）牙石的致病作用。